某男，19岁。暴饮暴食而致胃痛。辨证为饮食停滞，其临床特点是
A. 胃痛暴作，喜温恶寒
B. 胃痛胀满，嗳腐恶食
C. 胃痛隐隐，饥不欲食
D. 胃脘胀痛，连及胁肋
E. 胃脘灼痛，痛势急迫

正确答案：B。胃痛胀满，嗳腐恶食

解析：本题考查的是胃痛的辨证论治。辨证为饮食停滞，其临床特点是胃痛胀满，嗳腐恶食（B对）。胃痛又称胃脘痛，是以上腹胃脘部近心窝处疼痛为主要表现的疾病。西医学的胃炎、消化性溃疡、功能性消化不良等疾病以上腹部疼痛为主要表现者，可参考此内容辨证论治。（一）寒邪客胃证：【症状】胃痛暴作，喜温恶寒（A错），得温痛减，口和不渴，或喜热饮。舌淡，苔薄白，脉弦紧。（二）饮食伤胃证：【症状】胃脘疼痛，胀满拒按，嗳腐恶食，或吐不消化食物，吐后或矢气后痛减，大便不爽。舌淡红，苔厚腻，脉滑。（三）肝气犯胃证：【症状】胃脘胀痛，痛连两胁（D错），遇烦恼则痛作或痛甚，嗳气、矢气则舒，脘闷嗳气，善太息，大便不畅。舌淡红，苔薄白，脉弦。（四）湿热中阻证：【症状】胃脘疼痛，痛势急迫（E错），脘闷灼热，口干口苦，口渴不欲饮，纳呆恶心，小便色黄，大便不畅。舌红，苔黄腻，脉滑数。（五）胃阴亏耗证：【症状】胃脘隐隐灼痛，似饥而不欲食（C错），口干咽燥，口渴思饮，五心烦热，消瘦乏力，大便干结。舌红少津，脉细数。（六）脾胃虚寒证：【症状】胃痛隐隐，绵绵不休，喜温喜按，空腹痛甚，得食痛缓，劳累或受凉后发作或加重，时呕清水，神疲纳少，四肢倦怠，手足不温，大便溏薄。舌淡苔白，脉虚弱或迟缓。